属于阿片类麻醉性镇痛药的是
A. 曲马多
B. 依托考昔
C. 萘普生
D. 吗啡
E. 利多卡因

正确答案：D。吗啡

解析：本题考查镇痛药的分类。属于阿片类麻醉性镇痛药的是吗啡（D对）。临床使用的镇痛药可分为麻醉性镇痛药和非麻醉性镇痛药；非麻醉性镇痛药包括非甾体抗炎药、中枢性镇痛药（以曲马多为代表）以及其它机制的镇痛药。麻醉性镇痛药依来源可分为三类：（1）阿片生物碱：代表药吗啡；（2）半合成吗啡样镇痛药：如双氢可待因；（3）合成阿片类镇痛药：①苯哌啶类，如芬太尼；②二苯甲烷类，如美沙酮、右丙氧芬；③吗啡烷类，如左啡诺、布托啡诺；④苯并吗啡烷类，如喷他佐辛、非那佐辛。